某地夏季暴发肠道疾病的流行，调查发现，多数患者发病日期集中在同一潜伏期内，且病例分布与供水范围一致，为了尽快控制疾病的流行，应采取的对策是
A. 对症治疗
B. 应用抗生素
C. 隔离患者
D. 对污染水源立即采取净化和消毒措施
E. 对患者家里进行消毒

正确答案：D。对污染水源立即采取净化和消毒措施

解析：本题考查尽快控制疾病的流行，应采取的对策。根据调查结果，该肠道疾病多数患者发病日期集中在同一潜伏期内，且病例分布与供水范围一致，可以推断出水源可能受到污染，因此，为了尽快控制疾病的流行，应采取的最佳对策是对污染水源立即采取净化和消毒措施（D对ABCE错）。